关于阿司匹林的不良反应，错误的叙述是
A. 胃肠道反应最为常见
B. 凝血障碍，术前1周应停用
C. 过敏反应，哮喘、慢性荨麻疹患者不宜用
D. 水钠潴留，引起局部水肿
E. 水杨酸反应是中毒表现

正确答案：D。水钠潴留，引起局部水肿